来源于间叶组织的肿瘤是
A. 癌
B. 肉瘤
C. 母细胞瘤
D. 类癌
E. 临界肿瘤

正确答案：B。肉瘤

解析：来源于间叶组织的肿瘤有良、恶性之分，其中恶性肿瘤称为肉瘤（B对）。癌（A错）是来源于上皮组织的恶性肿瘤。母细胞瘤（C错）是指肿瘤的形态类似发育过程中的某种幼稚细胞或组织的肿瘤。类癌（D错）是起源于胃肠道和其他器官的内分泌细胞的低度恶性肿瘤。临界性肿瘤（E错）又称交界性肿瘤，是介于良性和恶性之间的肿瘤。